服用呋塞米可能引起
A. 心动过缓
B. 血钾降低
C. 血钾升高
D. 面部潮红
E. 下肢浮肿

正确答案：B。血钾降低

解析：本题考查药物的不良反应。服用呋塞米可能引起血钾降低（B对）。呋塞米的典型不良反应有水、电解质紊乱、低钾血症、耳毒性、高尿酸血症等。心动过缓（A错）是利福平的不良反应。血钾升高（C错）是ACEI类药物的不良反应。面部潮红（D错）是二氢吡啶类钙通道阻滞剂的不良反应。下肢浮肿（E错）是哌唑嗪的不良反应。